女孩，13岁，3天来右上后牙肿疼就诊。检查：14MO龋深，腐质黄软，探及髓腔，无疼痛，Ⅲ°松动，叩诊（+++），牙龈红肿，扪痛，有波动感，右侧面颊部轻度水肿，体温38℃。初诊的处理
A. 开髓暂封，切开引流，消炎止痛
B. 开髓暂封，切开引流
C. 拔牙，消炎止痛
D. 开髓开放，消炎止痛
E. 切开引流，消炎止痛

正确答案：A。开髓暂封，切开引流，消炎止痛

解析：年轻恒牙根尖周病变治疗，临床症状提示急性脓肿指征。有波动感，应切开引流，同时配合抗感染治疗。掌握“急性根尖周炎”知识点。